男性，50岁。肝硬化病史10年，以大量腹水3个月来诊。肝脾触诊应采用哪种方法
A. 单手触诊法
B. 双手触诊法
C. 滑动触诊法
D. 钩指触诊法
E. 冲击触诊法

正确答案：E。冲击触诊法

解析：冲击触诊法又称浮沉触诊法，其操作为检查时，右手并拢的示、中、环三个手指取70°～90°角，放置于腹壁拟检查的相应部位，作数次急速而较有力的冲击动作，在冲击腹壁时指端会有腹腔脏器或包块浮沉的感觉，此法常用于有大量腹水且伴有腹部脏器肿大或肿块的病人。本例患者有肝硬化伴大量腹水病史，肝脾触诊应采用冲击触诊法（E对）。单手触诊法（A错）、双手触诊法（B错）是肝脾触诊的常规方法，适用于无腹水或腹水较少的病人。滑动触诊法（C错）常用于腹腔深部包块和胃肠病变的检查。钩指触诊法（D错）是肝脏的触诊方法之一，适用于儿童和腹壁薄软者。